根据《行政处罚法》，下列情形不属于行政机构做出行政处罚之前应告知当事人有权要求举行听证的是
A. 药品监督管理部门拟对某药品上市许可持有人作出吊销《药品生产许可证》的行政处罚决定
B. 药品监督管理部门拟对某药品批发企业法定代表人作出限制从业的行政处罚决定
C. 药品监督管理部门拟对某药品生产企业作出责令停产停业的行政处罚决定
D. 药品监督管理部门拟对某药品零售企业作出警告的行政处罚决定

正确答案：D。药品监督管理部门拟对某药品零售企业作出警告的行政处罚决定

解析：本题考查行政处罚的程序。行政机关作出以下行政处罚决定之前，应当告知当事人有要求举行听证的权利：①较大数额罚款；②没收较大数额违法所得、没收较大价值非法财物；③降低资质等级或吊销许可证件（A对）；④责令停产停业（C对）、责令关闭、限制从业（B对）；⑤其他较重的行政处罚等；⑥法律、法规、规章规定的其他情形（D错，为本题正确答案）。